瘦肉精（克伦特罗）中毒的有效解救剂是
A. 氟马西尼
B. 碳酸氢钠
C. 普萘洛尔
D. 亚甲蓝
E. 维生素B₆

正确答案：C。普萘洛尔

解析：本题考查瘦肉精中毒解救。瘦肉精（克伦特罗）中毒的有效解救剂是普萘洛尔（C对）。克伦特罗为强效选择性β₂受体激动剂，中毒有效解救剂为β受体阻断剂如普萘洛尔、美托洛尔、艾司洛尔等。氟马西尼（A错）用于苯二氮䓬类药物中毒。碳酸氢钠（B错）常用于巴比妥类药物中毒。亚甲蓝（D错）用于氰化物中毒。维生素B₆（E错）用于酒精中毒。